生物碱在不同植物的含量差别
A. 极小
B. 较小
C. 很大
D. 相近
E. 相同

正确答案：C。很大

解析：本题考查的是生物碱在植物中的分布。生物碱在不同植物的含量差别很大（C对）。生物碱类主要分布于植物界，在动物界中少有发现。生物碱绝大多数存在于双子叶植物中，已知有50多个科的120多个属中存在生物碱。生物碱在不同的植物中含量差别也很大，高者可达百分之十几，低者仅含百万分之几，甚至千万分之几。如黄连根茎中含生物碱7%以上，金鸡纳树皮中生物碱含量为1.5%，长春花中长春新碱的含量为百万分之一，而抗癌成分美登素在卵叶美登木中仅为千万分之二。